下列关于服用阿昔洛韦治疗带状疱疹的说法，错误的是
A. 应尽早使用阿昔洛韦
B. 除口服外，可局部使用阿昔洛韦软膏
C. 口服给药，每日给药5次
D. 治疗疗程一般为7～10天
E. 阿昔洛韦主要经肝脏代谢，肾功能不全患者不需减量使用

正确答案：E。阿昔洛韦主要经肝脏代谢，肾功能不全患者不需减量使用

解析：本题考查药物的使用。下列关于服用阿昔洛韦治疗带状疱疹的说法，错误的是阿昔洛韦主要经肝脏代谢，肾功能不全患者不需减量使用（E错，为本题正确答案）。阿昔洛韦主要经肾排泄，可导致急性肾小管坏死，肾功能不全患者需减量使用。阿昔洛韦用于带状疱疹，应尽早应用（A对），可口服或局部使用（B对）。口服给药，0.4g，每日5次（C对），7～10天为一个疗程（D对）。